主治痰涎壅肺，上实下虚之喘咳的方剂是
A. 止嗽散
B. 定喘汤
C. 麻杏石甘汤
D. 小青龙汤
E. 苏子降气汤

正确答案：E。苏子降气汤

解析：苏子降气汤方含紫苏子、苏叶、半夏、甘草、前胡、厚朴、当归、肉桂、生姜、大枣，以祛痰降气，平喘止咳，兼温补下元，主治上实（痰涎壅肺）下虚（肾阳不足）之喘咳证（E对）。止嗽散功用为宣利肺气，疏风止咳，主治风邪犯肺之咳嗽证（A错）。定喘汤功用为宣肺降气，清热化痰，主治痰热内蕴，风寒外束之哮喘（B错）。麻杏石甘汤功用为辛凉疏表，清肺平喘，主治外感风邪，邪热壅肺证（C错）。小青龙汤功用为解表散寒，温肺化饮，主治外寒内饮证（D错）。